下列何结构经过内囊膝
A. 丘脑前辐射
B. 皮质核束
C. 丘脑中央辐射
D. 枕桥束
E. 无

正确答案：B。皮质核束

解析：皮质核束（B对）经过内囊膝部；丘脑前辐射（A错）经过内囊前肢；丘脑中央辐射（C错）经过内囊后肢；枕桥束（D错）由枕叶至脑桥核。